下列不是人畜共患疾病的是
A. 钩端螺旋体病
B. 伤寒
C. 结核病
D. 阿米巴痢疾
E. 血吸虫病

正确答案：B。伤寒

解析：本题考查人畜共患疾病。人畜共患疾病指脊椎动物与人类之间可以自然传播的疾病和感染。可分为四类：1.以动物为主的人畜共患疾病：这类疾病的病原体主要在动物间传播并延续，在一定条件下可以传给人，但人与人之间一般不传播，如狂犬病、森林脑炎、钩端螺旋体病（A对）等；2.以人为主的人畜共患疾病：疾病一般在人群中传播，偶然感染动物，如人型结核（C对）、阿米巴痢疾（D对）等；3.人畜并重的人畜共患疾病：人和动物均可作为传染源，并可互为传染源，如血吸虫病（E对）；4.真性人畜共患疾病病原体必须以人和动物分别作为终宿主和中间宿主，即病原体的生活史必须在人和动物体内协同完成，缺一不可，如牛绦虫病、猪绦虫病等。伤寒（B错，为本题正确答案）不是人畜共患疾病。